在月经后妊娠期胞宫的生理功能是
A. 藏而不泻
B. 泻而不藏
C. 亦泻亦藏
D. 主月经
E. 孕育胎儿

正确答案：A。藏而不泻

解析：经后期血室已闭，胞宫藏而不泻（A对），通过肾司封藏的作用，蓄养阴精，使精血渐长，充盛于冲任二脉，此为“阴血长养”阶段。行经期又称月经期。在肾中阳气司开阖的作用下，胞脉畅达，冲脉血海由满而溢，胞宫泻而不藏（B错），血室正开，经血下泄，气亦随血而泻。经前期胞宫亦藏亦泻（C错）。胞宫具有产生月经和孕育胎儿的作用（DE错）。